预防肾病综合征肾静脉血栓形成
A. 巯甲丙脯酸（开搏通）
B. 环磷酰胺
C. 低分子肝素
D. 甲泼尼龙（甲基强的松龙）
E. 呋塞米（速尿）

正确答案：C。低分子肝素

解析：预防肾病综合征肾静脉血栓形成，可给予肝素钠、低分子肝素（C对）、华法林等抗凝药。抗凝同时可辅以抗血小板药，如双嘧达莫、阿司匹林。巯甲丙脯酸（开搏通）（A错）就是卡托普利，ACEI类，用于高血压、心力衰竭等，无预防肾病综合征肾静脉血栓形成功效。环磷酰胺（B错）是细胞毒性药物，用于多用于激素治疗无效，或激素依赖型或反复发作型的肾病综合征患者的治疗，对肾静脉血栓形成的预防无作用。甲泼尼龙（甲基强的松龙）（D错）可以抑制免疫与炎症反应，但无法预防肾静脉血栓形成。呋塞米（速尿）（E错）可以利尿消肿，但同时会造成血液浓缩，会加大肾静脉血栓形成的可能，而非预防。